质量控制成分甾体皂苷的中药是
A. 知母
B. 丹参
C. 熊胆
D. 黄连
E. 莪术

正确答案：A。知母

解析：本题考查的是知母的质量控制成分。质量控制成分甾体皂苷的中药是知母（A对）。知母中的化学成分主要为甾体皂苷和芒果苷，还含有木脂素、甾醇、鞣质、胆碱等成分。《中国药典》上将知母皂苷BⅡ和芒果苷定为知母药材的质量控制成分，要求知母皂苷BⅡ含量不得少于3.0%，芒果苷的含量不得少于0.7%。饮片指标低于原药材，如蓝知母要求知母皂苷BⅡ含量不得少于2.0%，芒果苷含量不得少于0.40%。知母根茎中含皂苷约6%，其类型分别为螺甾烷醇类（如知母皂苷AⅢ等）、异螺甾烷醇类（如知母皂苷Ⅰ）和呋甾烷醇类（如知母皂苷BⅤ等）。丹参（B错）中的化学成分主要分为两类：脂溶性的二萜醌类化合物和水溶性的酚酸类成分。二萜醌类化合物大部分为丹参酮型的二萜醌类化合物，包括邻醌型的丹参酮类二萜和对醌型的罗列酮类二萜及其他类型。酚酸类成分主要是丹参素、丹酚酸A、丹酚酸B、丹酚酸C、迷迭香酸、原儿茶酸、紫草酸单甲酯，其中丹酚酸B是丹参中酚性酸的主要成分。《中国药典》要求测定丹参中丹参酮类和丹酚酸B的含量。熊胆（C错）的化学成分为胆汁酸类的碱金属盐及胆甾醇和胆红素。从生物活性方面讲，其主要有效成分为牛磺熊去氧胆酸，此外还有鹅去氧胆酸、胆酸和去氧胆酸。黄连（D错）的有效成分主要是生物碱，已经分离出来的生物碱有小檗碱（含量最高）、巴马汀、黄连碱、甲基黄连碱、药根碱和木兰碱（属于阿朴啡型）等；大多属苄基异喹啉类衍生物，季铵型生物碱。《中国药典》以小檗碱为指标成分进行含量测定。以盐酸小檗碱计，要求味连含小檗碱不得少于5.5%，表小檗碱不得少于0.80%，黄连碱不得少于1.6%，巴马汀不得少于1.5%；要求雅连含小檗碱不得少于4.5%；要求云连含小檗碱不得少于7.0%。莪术（E错）含挥发油1.0%～2.5%，《中国药典》规定原药材含挥发油不得少于1.5%（ml/g），饮片含挥发油不得少于1.0%（ml/g）。其中吉马酮、莪术醇、莪术二醇、莪术酮及莪术二酮等为倍半萜类化合物，是莪术挥发油的主要有效成分。